与特非那定同用可造成心律失常而中毒死亡的是
A. 各种白酒
B. 乳酪食品
C. 葡萄柚汁
D. 盐腌海鱼
E. 茶叶

正确答案：C。葡萄柚汁

解析：本题考查饮食对药物疗效的影响。与特非那定同用可造成心律失常而中毒死亡的是葡萄柚汁（C对）。特非那定是H₁受体阻断剂，葡萄柚汁含有柚苷等成分，两者同服会使血药浓度成倍上升，从而导致心律失常中毒死亡。酒（A错）的主要成分为乙醇，饮用后人体先是兴奋，随之对中枢神经出现抑制。乳酪食品（B错）含酪胺，可被人体单胺氧化酶代谢，不能与单胺氧化酶抑制药同服。盐腌海鱼（D错）属于高蛋白食物，不宜与异烟肼同服。茶叶（E错）中含有大量的鞣酸，能与药中的多种金属离子结合而发生沉淀，服药时不宜饮茶。